山药用治脾虚久泻，宜选用的炮制方法是
A. 炒黄
B. 砂炒
C. 土炒
D. 炒炭
E. 炒焦

正确答案：C。土炒

解析：本题考查的是山药的炮制方法及作用。山药用治脾虚久泻，宜选用的炮制方法是土炒（C对）。山药：【炮制作用】山药味甘，性平，归脾、胃、肾经。具有补脾益胃，生津益肺，补肾涩精的功能。①山药以补肾生精，益肺阴为主。用于肾虚遗精、尿频，肺虚喘咳，阴虚消渴。②土炒山药以补脾止泻为主，用于脾虚久泻。③麸炒山药以补脾健胃为主。用于脾虚食少，泄泻便溏，白带过多。土炒是将净选或切制后的药物与灶心土（伏龙肝）拌抄的方法。土炒的目的：灶心土味辛性温，能温中燥湿，止呕，止泻。常用来炮制补脾止泻的药物。如白术、山药等。炒黄（A错）是将净制或切制过的药物，置炒制容器内，用文火或中火加热，并不断翻动或转动，使药物表面呈黄色或颜色加深，或发泡鼓起，或爆裂，并逸出固有气味的方法。砂炒（B错）法，亦称砂烫法，是将净选或切制后的药物与热砂共同拌炒的方法。砂炒的目的：①增强疗效，便于调剂和制剂，如狗脊、穿山甲等。②降低毒性，如马钱子等。③便于去毛，如骨碎补等。④矫臭矫味，如鸡内金、脐带等。炒炭（D错）是将净选或切制后的药物，置炒制容器内，用武火或中火加热，炒至药物表面焦黑色或焦褐色，内部呈棕褐色或棕黄色。炒炭的目的：经炒炭炮制后可使药物增强或产生止血、止泻作用。炒焦（E错）是将净选或切制后的药物，置炒制容器内，用中火或武火加热，炒至药物表面呈焦黄或焦褐色，内部颜色加深，并具有焦香气味。炒焦的目的：主要是增强药物消食健脾的功效或减少药物的刺激性，如山楂、栀子等。